某男，60岁。5年前被确诊为支气管哮喘，多在夜间发作。发作时顿感胸部胀闷，呼吸困难（呼气延长）并伴有哮鸣音、干咳和紫绀。为减轻气喘，常被迫坐起，经西医治疗，症情缓解。为进一步缓解病情遂请中医诊治。因煎药不便，希望服用中成药。上药服用7天，病情稳定，症状又有所缓解。据此，医师嘱其继续服用该中成药。1月后，患者复来就诊。诉云：因前日嗜食辛辣与感受风寒，病情突然加重，刻下气粗痰涌，痰鸣如吼、咳呛阵作、痰黄稠厚，兼大便秘结、紫绀。医师诊断为支气管哮喘急性发作期痰瘀伏肺证，宜选用的中成药是
A. 橘红丸
B. 蠲哮片
C. 川贝止咳露
D. 小青龙糖浆
E. 蜜炼川贝枇杷膏

正确答案：B。蠲哮片

解析：本题考查的是蠲哮片的主治。刻下气粗痰涌，痰鸣如吼、咳呛阵作、痰黄稠厚，兼大便秘结、紫绀，诊断为支气管哮喘急性发作期痰瘀伏肺证，宜选用的中成药是蠲哮片（B对）。蠲哮片：【主治】支气管哮喘急性发作期痰瘀伏肺证，症见气粗痰涌、痰鸣如吼、咳呛阵作、痰黄稠厚。橘红丸（A错）：【主治】痰热咳嗽，痰多，色黄黏稠，胸闷口干。川贝止咳露（C错）：【主治】风热咳嗽，痰多上气或燥咳。小青龙糖浆（D错）：【主治】风寒水饮，恶寒发热、无汗、喘咳痰稀。蜜炼川贝枇杷膏（E错）：【主治】肺燥咳嗽，痰黄而黏，胸闷，咽喉疼痛或痒，声音嘶哑。